来源于百合科植物，药用部位是鳞茎的是
A. 川贝母
B. 浙贝母
C. 两者均是
D. 两者均不是

正确答案：C。两者均是

解析：本题考查的是川贝母与浙贝母的来源。来源于百合科植物，药用部位是鳞茎的是川贝母与浙贝母（C对）。川贝母（A错）：【来源】百合科植物川贝母、暗紫贝母、甘肃贝母、梭砂贝母、太白贝母或瓦布贝母的干燥鳞茎。浙贝母（B错）：【来源】百合科植物浙贝母的干燥鳞茎。